结合上皮下方的胶原纤维水肿、变性、消失，是以下哪项病理表现
A. 牙周炎静止期
B. 牙周炎活动期
C. 牙周变性
D. 牙周创伤
E. 牙周萎缩

正确答案：B。牙周炎活动期

解析：本题考查活动期牙周炎的病理变化。结合上皮下方的胶原纤维水肿、变性、消失，是牙周炎活动期（B对）的病理表现。牙周炎活动期的病理变化包括沟内上皮及结合上皮下方的胶原纤维水肿、变性、消失，大部分已被炎症细胞取代，牙槽嵴顶骨吸收明显这一特点。